在医学伦理学任务的提法中，错误的是
A. 为医学的发展导向
B. 反映社会对医学的需求
C. 为符合医学道德的行为辩护
D. 制定与预防、诊断、治疗相对应的伦理准则
E. 在医患关系中，只是竭力维护患者的权益

正确答案：E。在医患关系中，只是竭力维护患者的权益